1，4，5-三磷酸肌醇（IP₃）可以
A. 促进甘油二酯生成
B. 使细胞膜钙泵活性增强
C. 促进内质网中Ca²⁺释放至胞液
D. 促进Ca²⁺与CAM结合
E. 促进Ca²⁺与蛋白激酶C结合

正确答案：C。促进内质网中Ca²⁺释放至胞液